患者，男，31岁。夏季发病，出现急性剧烈腹泻伴喷射状呕吐，无腹痛，大便每日数十次，粪便白色水样。首先应考虑
A. 急性肠胃炎
B. 急性细菌性痢疾
C. 霍乱
D. 急性细菌性食物中毒
E. 伤寒

正确答案：C。霍乱

解析：本例患者夏季发病，急骤起病，出现急性剧烈腹泻伴喷射状呕吐，无腹痛，大便每日数十次，粪便白色水样，为无痛性腹泻，是霍乱（C对）的典型临床表现，严重者可导致周围循环衰竭和急性肾功能衰竭。急性肠胃炎（A错）临床表现主要为恶心、呕吐、腹痛、腹泻、发热等，亦常见于夏秋季，大便每日数次至数十次，轻型腹泻大便为黄色或黄绿色，少量粘液或白色皂块，较重的腹泻可为大量水样便，少量粘液；本例患者为无痛性腹泻，症状与之不符。急性细菌性痢疾（B错）好发于夏秋季节，，多表现为发热、腹痛、腹泻、里急后重、排黏液脓血便等，本例患者为无痛性腹泻，且大便性状与之不符，故不考虑急性细菌性痢疾可能。急性细菌性食物中毒（D错）多有发病前摄入被细菌和/或其毒素污染的食物或水的病史，表现为恶心、呕吐、腹痛、腹泻及水样便，本例患者为无痛性病史，发病前亦无误食史，故不考虑该诊断。伤寒（E错）临床表现为持续性发热、表情淡漠、相对缓脉、玫瑰疹、肝脾肿大及白细胞减少等，本例患者临床表现与之不符，无相对缓脉、玫瑰疹、白细胞计数减少等伤寒的典型表现，故不考虑该诊断。